医学道德所具有的特点，不包括的是
A. 具有全人类性
B. 具有实践性
C. 具有稳定性
D. 具有天然性
E. 具有继承性

正确答案：D。具有天然性

解析：医学道德的特点为具有全人类性（A对）、继承性（E对）、稳定性（C对）、实践性（B对）（D错，为本题正确答案）。